女性，28岁，右上后牙遇热水痛3天，咬物不用此侧已3个月。检查：右上第二前磨牙咬合面银色充填物边缘探龋洞达牙本质深层，叩痛（+）。热测引起痛，并持续数十秒。该患牙诊断应是
A. 深龋
B. 继发龋
C. 慢性牙髓炎
D. 可复性牙髓炎
E. 牙本质过敏症

正确答案：C。慢性牙髓炎

解析：此题干提示“龋洞达牙本质深层”和“热测引起疼痛，并持续数十秒”提示患牙已有牙髓炎症状。掌握“可复性、急慢性牙髓炎”知识点。